女性，44岁，健康体检发现甲状腺肿大就诊，查体甲状腺对称性Ⅱ°肿大，表面不平，中等硬度，无触痛，无血管杂音，心率78次/分，拟诊慢性淋巴性甲状腺炎，有助于确诊的首选检查是
A. TSH、FT₃、FT₄
B. 抗甲状腺抗体
C. 甲状腺B超
D. 甲状腺吸¹³¹I率
E. 甲状腺CT

正确答案：B。抗甲状腺抗体

解析：慢性淋巴细胞性甲状腺炎又称桥本甲状腺炎（HT），是一种以自身甲状腺组织为抗原的慢性自身免疫性疾病，常表现为无痛性弥漫性甲状腺肿大，质地坚硬，可检出甲状腺过氧化物酶抗体（TPO-Ab）和甲状腺球蛋白抗体（TG-Ab）等多种抗体。有弥漫性甲状腺肿大，TPOAb和TgAb（B对）显著增高，诊断即可成立。TSH、FT₃、FT₄（A错）是明确甲状腺功能的指标，无法确诊疾病类型。甲状腺B超（C错）仅可显示甲状腺的形态学变化。甲状腺吸¹³¹I率（D错）主要用于甲状腺摄碘功能的判断，慢性淋巴性甲状腺炎甲状腺摄碘功能可正常或减弱，无特异性。甲状腺CT（E错）不常用，在甲状腺疾病诊断治疗中，CT主要用于眼部眼外肌受累程度的判断。